诊断职业病最重要的前提条件是
A. 职业史
B. 临床表现
C. 现场调查
D. 实验室检查

正确答案：A。职业史

解析：本题考查职业病的诊断。职业病的诊断原则如下：1.职业史（A对BCD错）：是职业病诊断的重要前提；2.现场调查：是诊断职业病的重要依据；3.症状与体征；4.实验室检查：对职业病的诊断具有重要意义。